胺碘酮抗心律失常的作用机制是
A. 提高窦房结和浦肯野纤维的自律性
B. 加快浦肯野纤维和窦房结的传导速度
C. 缩短心房和浦肯野纤维的动作电位时程、有效不应期
D. 阻滞心肌细胞Na⁺、K⁺、Ca²⁺通道
E. 激动α及β受体

正确答案：D。阻滞心肌细胞Na⁺、K⁺、Ca²⁺通道

解析：本题考查胺碘酮。胺碘酮能够阻滞心肌细胞Na⁺、K⁺、Ca²⁺通道（D对）、降低窦房结的自律性（A错）、延长动作电位时程（C错）、抑制心房和心肌传导纤维的快钠离子流，减慢传导速度（B错），阻断α、β受体（E错）。